不属于细菌性肝脓肿临床特征的是
A. 全身中毒症状明显
B. 脓肿较小，常多发
C. 常继发于肠道感染
D. 穿刺液为咖啡色
E. 细菌培养可阳性

正确答案：D。穿刺液为咖啡色

解析：穿刺液为咖啡色（D错，为本题正确答案）常见于阿米巴性肝脓肿，细菌性肝脓肿的穿刺液为黄白色。细菌性肝脓肿的全身中毒症状明显（A对），突发寒颤高热，腺肿较小，常多发（B对），常继发于肠道感染（C对），细菌培养可阳性（E对）。